心指数是指下列哪项计算的心排出量
A. 单位体重
B. 单位年龄
C. 单位身高
D. 单位体表面积
E. 单位能量代谢率

正确答案：D。单位体表面积